流行病学实验研究与队列研究的主要不同点是
A. 研究对象分两组
B. 有对照
C. 属于前瞻性研究
D. 有干预措施

正确答案：D。有干预措施

解析：本题考查队列研究与实验流行病学的区别。队列研究与实验流行病学的区别在于是否有干预措施（D对ABC错）。